舌的味觉纤维走行于
A. 面神经和舌下神经
B. 舌下神经和迷走神经
C. 舌咽神经和迷走神经
D. 面神经和舌咽神经
E. 舌咽神经和舌下神经

正确答案：D。面神经和舌咽神经

解析：舌的味觉纤维走行于面神经和舌咽神经（D对）。面神经的味觉纤维分布于舌前2/3的味蕾，传导舌前2/3的味觉；舌咽神经的味觉纤维分布于舌后1/3的味蕾，传导舌后1/3的味觉。